我国常用的食品甜味剂有
A. 苯甲酸、山梨酸、丙酸
B. 糖精钠、甜味素、甜味菊苷
C. 硝酸盐、亚硝酸盐
D. 硫黄、亚硫酸钠
E. 没食子酸丙酯、二丁基羟基甲苯

正确答案：B。糖精钠、甜味素、甜味菊苷